蠲哮片除泻肺除壅，涤痰祛瘀外，还能
A. 纳气平喘
B. 解表定喘
C. 温肺定喘
D. 宣肺平喘
E. 利气平喘

正确答案：E。利气平喘

解析：本题考查蠲哮片的功能。蠲哮片除泻肺除壅，涤痰祛瘀外，还能利气平喘（E对）。蠲哮片【功能】泻肺除壅，涤痰祛瘀，利气平喘。补骨脂【功效】补肾壮阳，固精缩尿，温脾止泻，纳气平喘（A错）。小青龙胶囊（合剂、颗粒、糖浆）【功能】解表化饮，止咳平喘（B错）。小儿咳喘灵颗粒（口服液）【功能】宣肺清热，止咳祛痰，平喘（D错）。